既走表发汗，又走里温经的药是
A. 麻黄
B. 炮姜
C. 桂枝
D. 艾叶
E. 香茹

正确答案：C。桂枝

解析：本题考查桂枝的性能特点。既走表发汗，又走里温经的药是桂枝（C对）。桂枝【性能特点】本品辛散温通，甘温助阳。温通流畅，温助一身之阳气，流畅一身之血脉。入肺、膀胱经，善散风寒而解在表之风寒或风邪。入心经与血分，善温通助阳、散寒邪、通血脉、畅胸阳、温化水湿、止疼痛。发汗不及麻黄，长于助阳与流畅血脉。既走表，又走里，凡风寒表证无论虚、实皆宜，凡寒证无论虚、实或外寒直中或阳虚内生皆可。既入气分又入血分，血瘀有寒与阳虚水停用之为宜。【功效】发汗解肌，温通经脉，助阳化气。麻黄（A错）【性能特点】本品辛散温通，微苦略降，入肺、膀胱经。善开宣肺气而发汗解表、平喘，通调水道下输膀胱而利水消肿，温通散寒而通痹、散结。发散力强，平喘力好，治风寒表实无汗，兼咳喘者最宜。治肺气不宣之喘咳，风寒、寒痰者径用，风热、痰热者当配伍辛凉发散或清泄化痰之品。善治风水水肿，以及痹痛与阴疽。炮姜（B错）【性能特点】本品苦辛温散，微涩兼收，入脾、胃、肝经。既善温经止血，为治虚寒出血之要药；又善温中止泻、止痛，为治虚寒腹痛吐泻之佳品。艾叶（D错）【性能特点】本品辛香苦燥温散，生温熟热，炒炭兼敛，入肝、脾、肾经。内服炒炭温经散寒、暖宫、收敛而止血崩；生用温经散寒湿、暖宫理气血而止痛、止血、止带。外用煎汤熏洗，燥湿杀虫而止痒；温灸能温通经脉、散寒而止痛或消肿。作用偏于中下二焦，既为治妇科崩漏与带下之要药，又为灸科温灸之主药。香薷别名香茹，香茹（E错）【性能特点】本品辛微温发散，芳香化湿。入肺经，既发汗而解表，又宣肺、通调水道而利水；入脾、胃经，化湿而和中。发汗不伤阳，化湿不伤阴。外能发汗解表，内能化湿和中，夏日多用，故又称“夏月麻黄”。可代替麻黄以发表、宣肺、利水而消肿。